属于亲水凝胶骨架材料的是
A. Ⅱ号、Ⅲ号丙烯酸树脂
B. 羟丙甲纤维素
C. 硅橡胶
D. 离子交换树脂
E. 鞣酸

正确答案：B。羟丙甲纤维素

解析：本题考查骨架型缓（控）释材料。亲水性凝胶骨架材料可分为4类。①天然胶，如海藻酸盐、琼脂等；②纤维素衍生物，如甲基纤维素（MC）、羧甲基纤维素钠（CMC-Na）、羟丙甲纤维素（HPMC）（B对）、羟乙基纤维素（HEC）等；③非纤维素多糖类，如甲壳素、壳聚糖、卡波姆等；④高分子聚合物，如聚维酮（PVP）、聚乙烯醇（PVA）等。Ⅱ号、Ⅲ号丙烯酸树脂（A错）为肠溶包衣材料。硅橡胶（C错）为不溶性骨架材料。离子交换树脂（D错）是带有离子交换基团的不溶性高分子化合物。鞣酸（E错）是一种鞣质，大量用于制造蓝墨水。